以上属于副黏液病毒感染的疾病是
A. 急性化脓性腮腺炎
B. 慢性复发性腮腺炎
C. 流行性腮腺炎
D. 舍格伦综合征
E. 腮腺放线菌病

正确答案：C。流行性腮腺炎

解析：本题考查流行性腮腺炎。流行性腮腺炎（C对）是由副黏液病毒感染引起的疾病，多发生于儿童。急性化脓性腮腺炎（A错）的致病菌主要是金黄色葡萄球菌、溶血性链球菌。慢性复发性腮腺炎（B错）病因不明，与自身免疫病有关，先天性、广泛性导管扩张可为诱因。舍格伦综合征（D错）是一种自身免疫性疾病，病因不明。腮腺放线菌病（E错）是一类慢性化脓性肉芽肿性疾病，为衣氏放线菌感染所致。